关于龈下牙石的说法正确的是
A. 深褐色、黑色
B. 体积较小
C. 易沉积于邻面
D. 质地坚硬、致密
E. 以上均正确

正确答案：E。以上均正确

解析：本题考查龈下牙石的特点。龈下牙石呈深褐色、黑色（A对），比龈上牙石体积较小（B对），质地坚硬、致密（D对），一般与牙面的附着比龈上牙石更牢固。龈下牙石见于大多数牙周袋内，通常从釉牙骨质界延伸至袋底附近，在龈缘下分布较均匀，但易沉积于邻面（C对）和舌、腭面。综上所述，以上均正确(E对，为本题正确答案)。